未使用药品规范名称开具药品的处方属于
A. 不规范处方
B. 不适宜处方
C. 超常处方
D. 普通处方
E. 麻醉药品处方

正确答案：A。不规范处方

解析：本题考查不规范处方。未使用药品规范名称开具药品的处方属于不规范处方（A对）。有下列情况之一的，应当判定为超常处方（C错）：（1）无适应证用药；（2）无正当理由开具高价药的；（3）无正当理由超说明书用药的；（4）无正当理由为同一患者同时开具2种以上药理作用相同药物的。普通处方（D错）区分于特殊病种专用处方，处方的印刷用纸为白色。麻醉药品处方（E错）是开具麻醉药的处方。